属于难逆性抗胆碱酯酶药的是
A. 碘解磷定
B. 有机磷酸酯类
C. 乙酰胆碱
D. 氨甲酰胆碱
E. 毒扁豆碱

正确答案：B。有机磷酸酯类

解析：有机磷酸酯类属于难逆性抗胆碱酯酶药。掌握“难逆性抗胆碱酯酶药及胆碱酯酶复活药”知识点。